牙髓活力检查，热测试敏感。冷测试缓解。判断为
A. 可复性牙髓炎
B. 不可复性牙髓炎
C. 髓石
D. 牙髓钙化
E. 残髓炎

正确答案：B。不可复性牙髓炎

解析：本题考查不可复性牙髓炎的检查。牙髓活力检查，热测试敏感。冷测试缓解。判断为不可复性牙髓炎（B对）。不可复性牙髓炎是一类病变较为严重的牙髓炎症，病变可发生于牙髓的某一局部，也可能涉及全部牙髓，甚至在炎症的中心部位已发生了程度不同的化脓或坏死，当出现热疼冷缓解症状时，多标明患牙正处于牙髓炎化脓期。可复性牙髓炎（A错）：尤其对冷刺激激较敏感。牙髓钙化（D错）：存在两种形式：一种是结节性钙化，即为髓石（C错），可单一亦可多个分布于髓腔；另一种为弥漫性钙化，严重者可造成整个髓腔的闭锁；X线检查对诊断有重要意义。残髓炎（E错）：诊断要点为，患牙有牙髓治疗史。